化学物危险度评定的内容不包括
A. 危害鉴定
B. 危害表征
C. 接触评定
D. 危险度表征
E. 卫生标准制订

正确答案：E。卫生标准制订